属于水不溶型包衣材料的是
A. 羟丙基纤维素
B. 甲基纤维素
C. 醋酸纤维素
D. 微晶纤维素
E. 邻苯二甲醋酸纤维素

正确答案：C。醋酸纤维素

解析：本题考查片剂的包衣。醋酸纤维素（C对）是薄膜包衣材料中的水不溶型包衣材料；羟丙基纤维素（A错）是胃溶型包衣材料；甲基纤维素（B错）为黏合剂；微晶纤维素（D错）为稀释剂；邻苯二甲醋酸纤维素（E错）为肠溶型包衣材料。